具有免疫增强疗效的化学制剂是
A. 左旋咪唑
B. 环磷酰胺
C. 卡介苗
D. FK-506
E. 胸腺肽

正确答案：A。左旋咪唑